患者因劳累后，唇缘口角处见密集的小水庖，灼痒热痛，周身不适，心烦郁闷，大便干，小便黄，舌红，苔黄，脉弦数
A. 龙胆泻肝汤
B. 五味消毒饮
C. 黄连解毒汤
D. 导赤散
E. 辛夷清肺饮合竹叶石膏汤

正确答案：E。辛夷清肺饮合竹叶石膏汤

解析：患者劳累后，唇缘口角处见密集的小水庖，灼痒热痛，可诊断为热疮。热疮的常见证型有肺胃热盛证、湿热下注证和阴虚内热证。结合其热疮出现在“口角”，且伴有周身不适，心烦郁闷，大便干，小便黄，舌红，苔黄，脉弦数，可知为肺胃热盛证，治疗时应疏风清热，故应选用辛夷清肺饮合竹叶石膏汤（E对）。龙胆泻肝汤适用于热疮之湿热下注证，其疱疹发生于外阴（A错）。五味消毒饮（B错）、黄连解毒汤（C错）能够清热解毒，可用于治疗虫咬皮炎之热毒蕴结证。导赤散的功效为清热利水，用于心经火毒所致之疮疡（Ｄ错）。